某学者在某镇开展了一项待续多年的啤酒狂欢节饮酒者与心血管疾病死亡关系的研究。研究初，有70名啤酒狂欢节饮酒者和1500名未饮酒者，在研究结束时，70名啤酒狂欢节饮酒者死于心血管疾病，45名啤酒狂欢节未饮酒者死于心血管疾病。该研究为
A. 生态学研究
B. 临床试验
C. 病例对照研究
D. 队列研究
E. 横断面研究

正确答案：D。队列研究

解析：如题所述，该研究为在啤酒狂欢节参与人群中，以饮酒为暴露因素，追踪比较饮酒者与未饮酒者死于心血管疾病的差异，是典型的队列研究（D对）。生态学研究（A错）是在群体的水平上研究某种因素与疾病间的关系，以群体为观察和分析的单位，通过描述不同人群中某因素的暴露状况与疾病的频率，分析该暴露因素与疾病之间的关联。它与队列研究不同在于研究单位。病例对照研究（C错）是选择患有和未患有某特定疾病的人群分别作为病例组和对照组，判断暴露因素是否与研究的疾病有关联及其关联程度大小的一种观察性研究方法。临床试验（B错）是将来自同一总体的研究对象随机分为实验组和对照组，实验组给予实验因素，对照组不给予该因素，然后前瞻性地随访各组的结局并比较其差别的程度从而判断实验因素的效果。横断面研究（E错）一般用普查或抽样调查的方法收集特定时间、特定人群中疾病、健康状况及有关因素的资料，并对资料的分布特征加以描述。